单侧唇裂形成的胚胎基础为
A. 一侧内侧鼻突与上颌突未联合
B. 两侧内侧鼻突未融合
C. 上颌突和下颌突未融合
D. 上颌突与外侧鼻突未融合
E. 内侧鼻突与外侧鼻突未融合

正确答案：A。一侧内侧鼻突与上颌突未联合

解析：一侧上颌突未能在一侧与内侧鼻突融合，则在上唇一侧产生单侧唇裂。掌握“唇腭裂概述”知识点。